暑邪伤人出现气短乏力，甚则突然昏倒，不省人事等症状。是由于
A. 暑为阳邪，其性炎热
B. 暑多挟湿，阻遏气机
C. 暑邪伤人，易伤脾胃
D. 暑邪伤人，损伤津液
E. 暑性升散，最易耗气

正确答案：E。暑性升散，最易耗气

解析：暑邪性散，侵犯人体可致腠理开泄而汗出过多，不仅伤津，而且耗气，故临床除见口渴喜饮、尿赤短少等津伤症状外，往往可见气短、乏力，甚则气津耗伤太过，清窍失养而突然昏倒，不省人事（E对）。暑为阳邪，其性炎热（A错），暑邪伤人多表现为一系列阳热症状，如高热、心烦、面赤、脉洪大等；暑多夹湿，阻遏气机（B错），暑邪致病，多系湿邪为患。其临床表现除发热、烦渴等暑热症状外，常兼见身热不扬、汗出不畅、四肢困重、倦怠乏力、胸闷呕恶、大便溏泄不爽等湿滞症状。易伤津耗气的为火（热）邪（D错）。